变性蛋白质的主要特点是
A. 不易被蛋白酶水解
B. 分子量降低
C. 溶解性增加
D. 生物学活性丧失
E. 共价键被破坏

正确答案：D。生物学活性丧失